经炮制可降低苦寒之性，免伤脾阳，引药上行的饮片是
A. 炒黄柏
B. 酒黄柏
C. 盐黄柏
D. 黄柏炭
E. 蜜黄柏

正确答案：B。酒黄柏

解析：本题考查的是黄柏的炮制作用。经炮制可降低苦寒之性，免伤脾阳，引药上行的饮片是酒黄柏（B对）。黄柏：【炮制作用】黄柏味苦，性寒。归肾、膀胱经。具有泻火解毒，清热燥湿的功能。多用于湿热泄痢，黄疸，热淋，足膝肿痛，疮疡肿毒，湿疹，烫火伤等。①盐黄柏（C错）可引药入肾，缓和枯燥之性，增强滋肾阴、泻相火、退虚热的作用。多用于阴虚发热，骨蒸劳热，盗汗，遗精，足膝痿软，咳嗽咯血等。②酒黄柏可降低苦寒之性，免伤脾阳，并借酒升腾之力，引药上行，清血分湿热。用于热壅上焦诸证及热在血分。③黄柏炭（D错）清湿热之中兼具涩性，多用于便血、崩漏下血。炒黄柏（A错）与蜜黄柏（E错）的炮制作用，2022年考试指南未明确说明。